孕妇患风疹后，可能引起胎儿先天性畸形，此种传播方式称为
A. 空气传播
B. 医源性传播
C. “Z”型传播
D. 水平传播
E. 垂直传播

正确答案：E。垂直传播

解析：本题考查垂直传播。孕妇患风疹后，可能引起胎儿先天性畸形，此种传播方式称为垂直传播（E对ABCD错）。垂直传播是指病原体通过母体直接传给子代。